环境影响评价是对
A. 所有工程项目的评价
B. 所有规划项目的评价
C. 所有规划和建设项目的评价
D. 环境质量有较大影响的规划项目的评价
E. 环境质量有较大影响的规划和建设项目的评价

正确答案：E。环境质量有较大影响的规划和建设项目的评价

解析：本题考查环境影响评价。环境影响评价是环境质量评价的一项重要内容，是指对规划和建设项目实施后可能造成的环境影响进行分析、预测和评估（E对ABCD错），提出预防或者减轻不良环境影响的对策和措施，并进行跟踪监测的方法与制度。